青春期哪一系统发育速度骤然加快
A. 神经系统
B. 淋巴系统
C. 循环系统
D. 呼吸系统
E. 生殖系统

正确答案：E。生殖系统

解析：本题考查青春期的系统发育。儿童各系统、器官的生长发育不平衡，各系统的发育快慢不同，各有先后。如生殖系统（E对CD错）发育是先慢后快，体格发育是快慢快，在青春期发育速度骤热加快；神经系统（A错）发育是先快后慢，淋巴系统（B错）发育在儿童期较迅速，青春期达高峰，以后降至成人水平。